对于轻中度敏感菌感染，可一天1次给药的药物是
A. 头孢呋辛
B. 头孢他啶
C. 头孢米诺
D. 头孢唑林
E. 头孢曲松

正确答案：E。头孢曲松

解析：本题考查药物的用量。头孢曲松（E对）对于轻中度敏感菌感染，用量为成人及12岁以上儿童，一次1～2g，-日1次；危重或由中度敏感菌所引起的感染，剂量可增至一次4g，一日1次。头孢呋辛（A错）：成人对于轻中度敏感菌感染，常用量为每8h给予0.75～1.5g，疗程5～10日。头孢他啶（B错）：成人对于大多数感染，每8h给予1g或每12h给予2g。头孢米诺（C错）：成人的常用量为一次1g，一日2次静脉注射或静脉滴注。头孢唑林（D错）：成人对于轻中度敏感菌感染一日2～4次。